患儿，1岁。面色萎黄，困倦无力，不思乳食，食则饱胀，呕吐酸馊，大便溏薄酸臭。治疗应首选
A. 参苓白术散
B. 四君子汤
C. 健脾丸
D. 保和丸
E. 消乳丸

正确答案：C。健脾丸

解析：患儿不思乳食，食则饱胀，呕吐酸馊，当属“积滞”。小儿内伤乳食，停聚中焦，积而不化，气滞不行所形成的一种胃肠疾患，此证为脾虚夹积，脾胃虚弱，气血生化无源，则见面色萎黄，困倦无力，不思乳食，腐熟运化不及，乳食停滞不化，则见食则饱胀，呕吐酸馊，大便溏薄酸臭，治宜健脾丸，可健脾助运，消食化滞（C对）。参苓白术散适于脾虚泻（A错）。四君子汤补气健脾，适于脾胃气虚所致面色萎白，食少便溏（B错）。保和丸适于食积所致的呕吐、伤食泻、积滞中的食积者（D错）。消乳丸适于由乳汁积滞所致的呕吐、积滞（E错）。